某女，29岁。产后2周，患急性乳腺炎，一侧乳房肿胀疼痛，伴壮热不退，皮肤焮红灼热，继之肿块变软，有应指感，口渴喜饮，便秘溲赤；舌质红，苔黄腻，脉洪数，诊断为乳痈，证属热毒炽盛，宜选用的基础方剂为
A. 瓜蒌牛蒡汤合逍遥散
B. 五味消毒饮合透脓散
C. 逍遥蒌贝散合透脓散
D. 逍遥蒌贝散合五味消毒饮
E. 二仙汤合四物汤

正确答案：B。五味消毒饮合透脓散

解析：本题考查乳痈之热毒炽盛证的基础方剂。产后2周，患急性乳腺炎，一侧乳房肿胀疼痛，伴壮热不退，皮肤焮红灼热，继之肿块变软，有应指感，口渴喜饮，便秘溲赤；舌质红，苔黄腻，脉洪数，诊断为乳痈，证属热毒炽盛，宜选用的基础方剂为五味消毒饮合透脓散（B对）。乳痈之热毒炽盛证【症状】乳房肿痛加剧，皮肤焮红灼热，继之肿块变软，有应指感；或溃后脓出不畅，红肿热痛不消，有“传囊”现象；伴壮热不退，口渴喜饮，便秘溲赤。舌质红，苔黄腻，脉洪数。【方剂应用】基础方剂五味消毒饮（金银花、野菊花、蒲公英、紫花地丁、紫背天葵子）合透脓散（生黄芪、川芎、当归、穿山甲、皂角刺）加减。乳痈之气滞热壅证【症状】乳汁郁积结块，皮色不变或微红，肿胀疼痛；伴恶寒发热，周身酸楚，口渴，便秘。舌苔薄，脉数。【方剂应用】基础方剂瓜蒌牛蒡汤（A错）（瓜蒌仁、牛蒡子、天花粉、黄芩、山栀、金银花、连翘、皂角刺、青皮、陈皮、柴胡、生甘草）加减。乳癖之肝郁痰凝证【症状】多见于青壮年妇女。乳房肿块，质韧不坚，胀痛或刺痛，症状常随喜怒消长；伴胸闷胁胀，善郁易怒，失眠多梦，心烦口苦。舌苔薄黄，脉弦滑。【方剂应用】基础方剂逍遥蒌贝散（C错）（柴胡、当归、白芍、茯苓、白术、瓜蒌、贝母、半夏、南星、生牡蛎、山慈菇）加减。乳癖之冲任失调证【症状】多见于中年妇女。乳房肿块月经前加重，经后缓解；伴腰膝酸软，神疲倦怠，月经失调，量少色淡，或闭经。舌质淡，苔白，脉沉细。【方剂应用】基础方剂二仙汤（仙茅、淫羊藿、当归、巴戟天、黄柏、知母）合四物汤（E错）（当归、川芎、芍药、熟地黄）加减。